左心衰竭时，最早出现的症状是
A. 咳嗽、咳痰、咯血
B. 夜间阵发性呼吸困难
C. 劳力性呼吸困难
D. 端坐呼吸
E. 乏力、疲倦、头昏、心慌

正确答案：C。劳力性呼吸困难

解析：劳力性呼吸困难是左心衰最早出现的症状（C对），随病情加重可逐渐出现夜间阵发性呼吸困难（B错）、端坐呼吸（D错），伴有咳嗽、咳痰、咯血（A错）、乏力、疲倦、头昏、心慌（E错）等症状。